诱导操纵子表达的是
A. 阻遏蛋白
B. TFⅡB
C. CAP
D. 乳糖
E. 结构基因

正确答案：D。乳糖